带下黄臭，外阴瘙痒，其证型是
A. 胆郁痰扰
B. 寒滞肝脉
C. 肝气郁结
D. 肝胆湿热
E. 肝肾阴虚

正确答案：D。肝胆湿热

解析：带下黄臭，外阴瘙痒，主要因湿热循肝经下注所致，为肝胆湿热证（D对）。胆郁痰扰（A错）证候表现为惊悸失眠，胆怯易惊，口苦呕恶，胸胁闷胀舌红，苔黄腻，脉弦数。寒滞肝脉（B错）证候表现为少腹冷痛，阴囊收缩，睾丸抽痛，舌苔白，脉沉弦或沉紧。肝气郁结（C错）证候表现为胸胁、少腹胀满疼痛，走窜不定，善太息，苔薄白，脉弦。肝肾阴虚（E错）证候表现为头晕目眩，胸胁隐痛，两目干涩，耳鸣健忘，失眠多梦，口燥咽干，五心烦热，舌红少苔，脉细数。